中和胃酸而降低胃内酸度
A. 奥美拉唑
B. 西咪替丁
C. 硫糖铝
D. 哌仑西平
E. 氢氧化铝

正确答案：E。氢氧化铝